属于足骨的是
A. 月骨
B. 距骨
C. 三角骨
D. 头状骨
E. 大多角骨

正确答案：B。距骨

解析：距骨属于足骨(B对)，月骨（A错）、三角骨（C错）、头状骨（D错）、大多角骨（E错）均属于手骨。